《食品安全法》中，关于从业人员健康体检的规定，错误的是
A. 上岗前必须进行健康检查，合格者方可上岗
B. 已上岗者每年进行一次健康检查
C. 从业人员离岗时也要进行健康检查
D. 患有伤寒者，不得从事接触直接入口食品的工作
E. 患有活动性肺结核者，不得从事接触直接入口食品的工作

正确答案：C。从业人员离岗时也要进行健康检查